妊娠期糖尿病者宜首选
A. 胰岛素
B. 格列喹酮
C. 二甲双胍
D. 普伐他汀
E. 阿卡波糖

正确答案：A。胰岛素

解析：本题考查妊娠期糖尿病者首选药。妊娠糖尿病首选胰岛素（A对）进行治疗。格列喹酮（B错）为糖尿病合并肾病的首选。二甲双胍（C错）为2型肥胖型糖尿病的首选。普伐他汀（D错）为调节血脂药。阿卡波糖（E错）可作为单纯餐后血糖高，而空腹和餐前血糖不高的首选。